幼儿急疹发热与出疹的关系是
A. 发热数小时～1天出疹
B. 发热1～2天出疹
C. 发热3～4天出疹，出疹时发热更高
D. 发热3～4天出疹，疹出热退
E. 发热与出疹无明显关系

正确答案：D。发热3～4天出疹，疹出热退

解析：幼儿急疹，是人疱疹病毒6、7型导致的婴幼儿期常见的一种发疹性疾病，以持续高热3～4天，热退疹出为临床特点（D对E错）。风疹是发热数小时～1天出疹（A错）。猩红热是发热1～2天出疹（B错）。麻疹是发热3～4天出疹，出疹时发热更高（C错）。